性温有毒，大剂量可引起心律失常、全身震颤，甚至死亡的药是
A. 川乌
B. 路路通
C. 豨莶草
D. 香加皮
E. 臭梧桐

正确答案：D。香加皮

解析：本题考查的是香加皮的使用注意。性温有毒，大剂量可引起心律失常、全身震颤，甚至死亡的药是香加皮（D对）。香加皮：【使用注意】本品苦辛温燥，能伤阴助火，故阴虚火旺者慎服。含强心苷而有毒，大剂量可引起心律失常、全身震颤，甚则死亡，故不宜过量或长期服用，不宜与西药地高辛等强心苷类药同用。川乌（A错）：【使用注意】本品性热有毒，故孕妇忌服，不宜过量或久服。反半夏、全瓜蒌、瓜蒌子、瓜蒌皮、天花粉、川贝母、浙贝母、白蔹、白及，畏犀角，均不宜同用。酒浸毒性强，故不宜浸酒饮用。路路通（B错）：【使用注意】本品能通经下乳，故孕妇及月经过多者慎服。豨莶草（C错）：【使用注意】生用或大剂量用易致呕吐，故内服不宜过量。臭梧桐（E错）：【使用注意】内服不宜过量，无风湿者慎服。